位于软硬腭结合处的稍后方中线两侧的是
A. 切牙乳突
B. 上颌结节
C. 腭小凹
D. 颊棚区
E. 磨牙后垫

正确答案：C。腭小凹

解析：本题考查种植覆盖全口义齿。腭小凹（C对）：腭小凹为位于软硬腭结合处稍后方中线的两侧，左右各一个的黏膜表面陷窝，内有黏液腺导管的开口。上颌全口义齿的后缘应在腭小凹后2mm处。